大豆中含量较多、可弥补谷类食物不足的氨基酸是
A. 蛋氨酸
B. 苏氨酸
C. 缬氨酸
D. 亮氨酸
E. 赖氨酸

正确答案：E。赖氨酸

解析：本题考查大豆中含量较多、可弥补谷类食物不足的氨基酸。利用蛋白质互补作用将谷类与豆类等含丰富赖氨酸的食物混合食用，可弥补谷类食物赖氨酸（E对ABCD错）的不足，提高谷类蛋白质的营养价值。